患者近2年来倦怠乏力，食欲减退，间歇性鼻出血，齿龈出血。今进食粗糙硬质食物后，突然大量呕鲜红色血，并出现黑便。检查：血压明显下降，心率120次/分，腹部膨隆，有移动性浊音，肝脾触诊不满意。应首选的止血措施是
A. 正肾加冰盐水洗胃
B. 三腔管压迫止血
C. 迅速补充血容量
D. 肌注安络血
E. 静滴止血环酸

正确答案：E。静滴止血环酸

解析：患者进食粗糙硬质食物后，突然大量呕鲜红色血，并出现黑便。检查：血压明显下降，心率增快，腹部膨隆，有移动性浊音，肝脾触诊不满意，为上消化道大出血引发失血性休克，首选的治疗措施是静滴止血环酸（E对）控制出血。